为防止絮凝体破碎，平流式沉淀池进水区的流速多采用
A. 0.1m/s
B. 0.3m/s
C. 0.5m/s
D. 0.05m/s
E. 0.005m/s

正确答案：D。0.05m/s

解析：本题考查沉淀的相关内容。混凝过程中生成的絮凝体和其他悬浮颗粒依靠重力作用，从水中分离出来
的过程称为沉淀。所用的沉淀设施主要有平流式沉淀池和斜板与斜管沉淀池。为防止絮凝体破碎，平流式沉淀池进水区的流速多采用0.05m/s（D对ABCE错）。